以下哪项可造成围生期维生素D不足
A. 早产、双胎
B. 慢性腹泻
C. 肝肾疾病
D. 母亲严重营养不良
E. 以上都可

正确答案：E。以上都可

解析：围生期维生素D不足：母亲妊娠期，特别是妊娠后期维生素D营养不足，如母亲严重营养不良、肝肾疾病、慢性腹泻，以及早产、双胎均可使得婴儿体内贮存不足。掌握“维生素D缺乏性佝偻病”知识点。